乙型强心苷是
A. 甾体母核C-17位连有五元不饱和内酯环的化合物
B. 甾体母核C-17位连有六元不饱和内酯环的化合物
C. 甾体母核C-17位连有五碳醛糖的化合物
D. 甾体母核C-17位连有六碳醛糖的化合物
E. 甾体母核C-17位连有α-去氧糖的化合物

正确答案：B。甾体母核C-17位连有六元不饱和内酯环的化合物

解析：本题考查的是强心苷元的分类。乙型强心苷是甾体母核C-17位连有六元不饱和内酯环的化合物（B对）。强心苷是存在于生物界中的一类对心脏有显著生理活性的甾体苷类。根据C-17侧链不饱和内酯环的不同，将强心苷元分为两类。①甲型强心苷元（强心甾烯类）：甾体母核的C-17侧链为五元不饱和内酯环（A错），基本母核称为强心甾，由23个碳原子构成。在已知的强心苷元中，大多属于此类。②乙型强心苷元（海葱甾二烯或蟾蜍甾二烯类）：甾体母核的C-17侧链为六元不饱和内酯环，基本母核为海葱甾或蟾蜍甾。自然界中仅少数苷元属此类，如中药蟾蜍中的强心成分蟾毒配基类。